男，59岁。2型糖尿病病史7年，口服格列本脲15mg/d和二甲双胍2.0g/d治疗。8个月前眼底检查可见微血管瘤、出血和硬性渗出。近1个月来视力明显减退，眼底检查可见视网膜新生血管形成和玻璃体积血。BP160/100mmHg，BMI28.4空腹血糖7.1mmmol/L，餐后2小时血糖14.6mmol/L，糖化血红蛋白7.6%。目前该患者糖尿病视网膜病变的分期为
A. Ⅰ期
B. Ⅴ期
C. Ⅲ期
D. Ⅱ期
E. Ⅳ期

正确答案：E。Ⅳ期

解析：中老年男性患者，2型糖尿病7年病史，近一个月来视力明显减退，眼底检查可见视网膜新生血管形成和玻璃体积血，依据2002年国际临床分级标准，本例患者眼底检查符合糖尿病视网膜病变Ⅳ期（E对）。2002年国际临床分级标准依据散瞳后检眼镜检查，将糖尿病视网膜改变分为两大类、六期。Ⅰ期（A错）：微血管瘤、小出血点；Ⅱ期（D错）：出现硬性渗出；Ⅲ期（C错）：出现棉絮状软性渗出；Ⅳ期：新生血管形成、玻璃体积血；Ⅴ期（B错）：纤维血管增殖、玻璃体机化；Ⅵ期：牵拉性视网膜脱离、失明。以上Ⅰ-III期为非增殖期视网膜病变（NPDR），Ⅳ-Ⅵ期为增殖期视网膜病变（PDR）。